患者，男，55岁。胸痛如窒，痛引肩背。气短喘促，四肢沉重，形体肥胖，舌苔浊腻，脉滑。其证候是
A. 心血瘀阻
B. 阴寒凝滞
C. 痰浊壅塞
D. 阳气虚衰
E. 气阴两虚

正确答案：C。痰浊壅塞

解析：痰浊盘踞，胸阳失展，故见胸闷如窒；阻滞脉络，故痛引肩背；气机痹阻不畅，故见气短喘促；脾主四肢，痰浊困脾，脾气不运，故四肢沉重；形体肥胖，舌苔浊腻，脉滑，为痰浊闭阻之征（C对）。心血瘀阻（A错）多为刺痛，伴唇甲青紫，或有瘀斑，脉沉弦涩。阴寒凝滞（B错）为绞痛加形寒畏冷，四肢不温，冷汗自出。阳气虚衰（D错）有虚寒象，伴有气短乏力，畏寒肢冷，面色苍白，唇甲淡白。气阴两虚证（E错）的特点为胸闷心痛，心悸不宁，气短乏力，心烦少寐，自汗盗汗，口干耳鸣，腰膝酸软。